患者，女，22岁。恶寒，高热，咳嗽，胸痛1天入院。检查：血压85/50mmHg（11.4/6.7kPa），脉搏100次/分，X线胸片示右上肺大片片状阴影，呈肺段分布。白细胞21×10⁹/L。其诊断是
A. 休克型肺炎
B. 病毒性肺炎
C. 支原体肺炎
D. 肺炎球菌肺炎
E. 肺脓肿

正确答案：D。肺炎球菌肺炎

解析：患者发热，咳嗽，胸痛，白细胞增高，为炎症表现，X线胸片示右上肺大片片状阴影，呈肺段分布，故可诊断为肺炎球菌肺炎（D对）。休克型肺炎（A错）表现为皮肤粘膜苍白湿冷，血压下降的休克表现；病毒性肺炎（B错）X线检查可见肺纹理增多，小片状或广泛浸润；支原体肺炎（C错）X线表现为胸部多种形态的浸润影，节段性分布；肺脓肿（E错）表现为咳吐大量腥臭脓痰。